尸体器官采集应遵守的伦理和法律规定是
A. 医务人员不得有意无意地进行商业行为的器官移植
B. 确定死亡的医师不得同时是实施器官移植手术者
C. 捐赠者应被告知器官摘除可能带来的后果和危险
D. 对捐赠者亲属有告知义务，坚持亲属的知情同意
E. 对活体捐赠者在移植过程中，尽量避免或减少并发症

正确答案：B。确定死亡的医师不得同时是实施器官移植手术者

解析：从事人体器官移植的医务人员不得参与捐献人的死亡判定（B对）。原则规定了禁止通过商业性的方式征求器官（A错）。在摘取活体器官捐赠者捐赠的器官前，应当充分告知捐赠者及其家属摘取器官手术风险、术后注意事项、可能发生的并发症及预防措施等，并签署知情同意书（CDE错）。